颧突是上颌骨骨化中心向哪个方向进行生长所形成的
A. 向前
B. 向后
C. 向内
D. 向外
E. 向下

正确答案：B。向后

解析：上颌骨向后形成颧突。掌握“唾液腺与颌骨的发育”知识点。